对肿瘤进行穿刺细胞学检查时通常使用
A. 5号针头
B. 6号针头
C. 9号针头
D. 8号针头
E. 12号针头

正确答案：B。6号针头

解析：近年来对唾液腺或某些深部肿瘤也可以用6号针头行穿刺细胞学检查，或称“细针吸取活检”。此法需要有细胞学检查诊断的基本训练，区别良恶性肿瘤的确诊率可达95%，但有时对肿瘤的组织学类型难以完全肯定。掌握“口腔颌面部肿瘤的概念、临床表现、诊断”知识点。